摇头咳嗽打喷嚏使头痛加剧的是
A. 丛集性头痛
B. 腰椎穿刺后头痛
C. 颈肌急性炎症
D. 神经官能症
E. 脑肿瘤

正确答案：E。脑肿瘤

解析：摇头咳嗽打喷嚏使头痛加剧的是脑肿瘤（E对）。丛集性头痛在站位可缓解（A错）。腰椎穿刺后的头痛在直立位时加重（B错）。因颈部运动而加重的是颈肌急性炎症（C错）。神经性头痛因精神紧张、失眠等诱发（D错）。